“无论是致病、治疗，还是预防和康复都应将人视为一个整体，需要考虑各方面因素的交互作用，而不能机械地将他们分割开”。此观点所反映的医学模式是
A. 自然哲学的医学模式
B. 生物-心理-社会医学模式
C. 神灵主义的医学模式
D. 机械论医学模式
E. 生物医学模式

正确答案：B。生物-心理-社会医学模式

解析：原来的生物医学模式已不足以阐明人类健康和疾病的全部本质，疾病的治疗也不能单凭药物或手术，人们对于健康的要求已不再停留在身体上的无病，而是更追求心身的舒适和协调，因此医学模式，需要得到转变，形成了生物-心理-社会医学模式（B对）。自然哲学的医学模式是以中国古代中医提出的“天人合一”的思想及古希腊希波克拉底等人提出的“体液学说”等为代表。这一模式的哲学观以朴素的唯物论、整体观和心身一元论为基础（A错）。神灵主义的医学模式起源于原始社会，由于当时的生产力水平极为低下，人们相信“万物有灵”，将疾病看作是神灵的惩罚或恶魔作祟所致。人们治疗疾病的手段或者祈祷神灵的保佑或宽恕，或者采取驱鬼或避邪的方式免除疾病（C错）。生物医学模式更重视身体和生理上的问题，而不重视心理和社会的因素，是将这些方面机械的分割开来（E错）。